女，25岁。发热伴下肢和腹部皮肤瘀斑5天。查体：双下肢和腹部皮肤有多处瘀斑，双侧颈部、腋窝和腹股沟可触及淋巴结肿大，活动无压痛，最大者为2.0cm×2.5cm，胸骨压痛（+），腹软，肝肋下1.5cm，脾肋下2cm。化验：Hb78g/L，WBC18×10⁹/L，分类可见原始和幼稚细胞，PLT25×10⁹/L，网织红细胞0.002。明确诊断后，首选的治疗措施是
A. ABVD方案化疗
B. VDLP方案化疗
C. 给予大剂量糖皮质激素
D. DA方案化疗
E. CHOP方案化疗

正确答案：B。VDLP方案化疗

解析：患者确诊为急性淋巴细胞性白血病后，首选的治疗措施是VDLP方案化疗（B对）。ABVD方案（P585）（A错）是霍奇金淋巴瘤的首选化疗方案；大量糖皮质激素（P820）（C错）可用于系统性红斑狼疮的治疗；DA方案（P576）（D错）是急性髓系白血病的首选治疗方案；CHOP方案（P590）（E错）是非霍奇金淋巴瘤的标准治疗方案。